患儿，男，5岁。患急性肾小球肾炎。眼睑先肿，迅速波及全身，以头面部肿势为著，伴有发热，恶风，咳嗽，苔薄白，脉浮。其证型是
A. 风水相搏
B. 湿热内蕴
C. 水毒内闭
D. 脾虚湿困
E. 脾肾阳虚

正确答案：A。风水相搏

解析：本病例已明确指出患儿为急性肾小球肾炎，属中医学“水肿”之“阳水”；“眼睑先肿，迅速波及全身，以头面部肿势为著，伴有发热，恶风，咳嗽，苔薄白，脉浮”，可诊断为“阳水”之风水相搏证（A对）--风性向上，善行而数变，故水肿从眼睑开始，迅速波及全身，以头面部肿势为著；发热，恶风，咳嗽，为卫表受风邪，肺失清肃；苔薄白，脉浮，为风邪外袭之征。当治以疏风宣肺，利水消肿，宜选麻黄连翘赤小豆汤。急性肾小球肾炎之湿热内蕴（B错）证，以尿少色赤，皮肤生疮或咽喉肿痛，头身困重为特征性表现。急性肾小球肾炎之水毒内闭（C错）证，以尿少尿闭，头晕头痛，恶心呕吐，嗜睡或昏迷为特征性表现。